突发耳鸣，声大如潮，按之不减的临床意义是
A. 寒水上泛
B. 肝胃郁热
C. 湿热蕴脾
D. 风邪上袭
E. 痰湿上蒙

正确答案：D。风邪上袭

解析：突发耳鸣，声大如雷，按之尤甚，属实证。多由肝胆火扰、肝阳上亢，或痰火壅结、气血瘀阻、风邪上袭，或药毒损伤耳窍等所致（D对）。